下列关于健康传播概念的叙述不正确的是
A. 健康传播是一种社会性传递健康信息的行为
B. 健康传播追求的效果是知晓健康信息
C. 健康传播者是健康信息的把关人
D. 健康传播是健康教育与健康促进的重要策略
E. 健康传播需运用各种传播媒介和手段

正确答案：B。健康传播追求的效果是知晓健康信息